将苯丙氨酸引入氮芥结构中得到美法伦的目的是
B. 延长药物的作用时间
C. 降低药物的毒副作用
D. 改善药物的吸收性能
E. 增加药物对特定部位作用的选择性

正确答案：E。增加药物对特定部位作用的选择性

解析：本题考查药物的化学结构修饰。将苯丙氨酸引入氮芥结构中得到美法伦的目的是增加药物对特定部位作用的选择性（E对）。药物的化学结构修饰是希望通过化学结构的改变，达到发挥最佳药物作用的效果。在抗肿瘤药物中，为了提高抗肿瘤药物的选择性，希望药物能较多地进入肿瘤组织中。利用肿瘤组织对氨基酸的需求量比较大的特点，将苯丙氨酸引入氮芥类药物，如在氮芥结构中引入苯丙氨酸得到美法仑，使其较多地富集在肿瘤组织中。